双嘧达莫抗血小板的作用机制是抑制
A. 血栓烷合成酶
B. 磷酸二酯酶
C. 环氧酶
D. 血小板腺苷环化酶
E. 凝血酶

正确答案：B。磷酸二酯酶

解析：本题考查抗血小板药的作用机制。双嘧达莫为磷酸二酯酶（B对）抑制剂，通过抑制磷酸二酯酶对cAMP的降解作用，使血小板内cAMP浓度增高而产生抗血小板作用。奥扎格雷钠为血栓烷合成酶（A错）抑制剂。阿司匹林有抑制环氧酶（C错）作用。前列环素为血小板腺苷环化酶（D错）刺激剂。凝血酶（E错）通过激活血小板，催化纤维蛋白原转化为纤维蛋白，促进血块稳定。